患者，女，52岁。肉瘿病史3年。近来颈前肿块突然增大，质地坚硬如石，推之不动。应首先考虑的是
A. 失荣
B. 瘰疬
C. 瘿痈
D. 气瘿
E. 石瘿

正确答案：E。石瘿

解析：失荣是发于颈部耳之前的岩肿，生长较快，质地坚硬，溃后疮面渗流血水，高低不平，且患者多面容憔悴，形体消瘦，常由口腔、喉部、鼻部或脏腑的岩转移而来，题中患者为肉瘿病史，且无面容憔悴、形体消瘦等虚弱症状（A错）。瘰疬为多枚结核，累累如串珠状，多发于儿童或青年，好发于颈部的一侧或两侧，初期推之能动，不热不痛，多无全身症状，中期结核增大，皮核黏连，可互相融合成块，推之不动，后期溃后流脓清稀。瘰疬虽然中期推之不动，但有疼痛，多成脓，且题中病例患者有肉瘿病史，肿块质地坚硬如石（B错）。瘿痈的临床特点为结喉两侧结块，色红灼热，疼痛肿胀，甚至化脓，疼痛可牵引至耳后枕部，活动或吞咽时加重，常伴发热、头痛等症状，题中肿块质地坚硬如石，未提及疼痛，无发热、头痛症状（C错）。气瘿的临床特点为女性发病率较男性略高。一般多发生在青春期，初起时无明显不适感，甲状腺呈弥漫性肿大，腺体表面较平坦，质软不痛，皮色如常，腺体随吞咽动作而上下移动，题中肿块质地坚硬如石，推之不动（D错）。题中该患者女，52岁，既往有肉瘿病史，进来颈前肿块迅速增长，质地坚硬如石，推之不动，符合石瘿的诊断（E对）。